10岁，右大腿下端疼痛伴高热达39.5℃1天。怀疑为急性化脓性骨髓炎。若已确定诊断最关键的治疗方法为
A. 卧床休息
B. 大量广谱抗生素
C. 肢体制动
D. 输液、注意水电平衡
E. 大量广谱抗生素+钻孔引流

正确答案：E。大量广谱抗生素+钻孔引流

解析：10岁儿童（急性化脓性骨髓炎的好发年龄，好发于儿童和青少年），右大腿下端（化脓性骨髓炎的好发部位，多发于胫骨近端和股骨远端）疼痛伴高热达39.5℃（正常值为36℃～37℃）1天（早期），结合该患者的临床表现和体征，该患者的诊断考虑为急性化脓性骨髓炎。最关键治疗:抗生素+钻孔引流 最先治疗:抗生素 。最好在抗生素治疗48-72h后仍不能控制局部症状时进行手术治疗应积极，以防发生中毒性休克和感染蔓延。局部治疗也应及早进行，力争在急性期获得治愈。引流越早、越彻底越好（E对）。